预防丙型肝炎最重要的措施是
A. 使用一次性注射器
B. 严格筛选献血员
C. 丙型肝炎疫苗的接种
D. 注射高效价免疫球蛋白
E. 注意饮水及饮食卫生，防止“病从口入”

正确答案：A。使用一次性注射器